控制普通型疟疾发作多选用的药物是
A. 哌喹
B. 伯氨喹
C. 青蒿素
D. 奎宁
E. 乙胺嘧啶

正确答案：C。青蒿素

解析：目前控制普通型疟疾发作多选用的药物是青嵩素（C对）衍生物为基础与另一种有效抗疟疾药物的联合方案。哌喹（P273）（A错）类似于氯喹，是长效抗疟药。可杀灭红细胞内裂体增殖期疟原虫，控制临床发作。伯氨喹（P273）（B错）可杀灭红细胞内疟原虫配子体和肝细胞内迟发型子抱子，用于防止疟疾的传播与复发。奎宁（P274）（D错）可杀灭红细胞内裂体增殖疟原虫，用于脑型疟疾的治疗。